治疗胃痛脾胃虚寒证，应首选
A. 小建中汤
B. 理中丸
C. 附子理中丸
D. 良附丸
E. 黄芪建中汤

正确答案：E。黄芪建中汤

解析：小建中汤功能温中补虚，缓急止痛，为腹痛中脏虚寒证的首选方（A错）。理中丸功能温中祛寒，补气健脾，为久泻脾胃虚弱证偏脾阳虚的选方（B错）。附子理中丸功能温阳祛寒，补气健脾，为久泻肾阳虚衰证伴脐腹冷痛的选方（C错）。胃痛寒邪客胃证治宜温胃散寒，行气止痛，方选香苏散和良附丸（D错）。胃痛脾胃虚寒证是由于脾虚胃寒，不能温养胃导致的疼痛，治宜温中健脾，和胃止痛，首选具有温中散寒、和胃止痛功效的黄芪建中汤（E对）。